色谱柱理论计算公式n=5.54（tR/Wh/2）2中，tR的含义是
A. 峰面积
B. 峰高
C. 保留时间
D. 峰宽
E. 半高峰宽

正确答案：C。保留时间